一氧化碳中毒最有效的治疗方法是
A. 采用高浓度氧气面罩
B. 注射呼吸兴奋剂
C. 撤离中毒现场
D. 人工呼吸
E. 高压氧舱

正确答案：E。高压氧舱

解析：救急性一氧化碳中毒，最有效的治疗方法是是高压氧舱治疗（E对），能增加血液中物理溶解氧，提高总体氧含量，促进氧释放和加速CO排除，可迅速纠正组织缺氧，缩短昏迷时间和病程，预防CO中毒引发的迟发性脑病。